急性广泛性前壁心肌梗死患者，胸闷憋气明显，心率140次/分，双肺可闻及弥漫性小水泡音，首选的治疗措施是
A. 给予钙拮抗剂，以缓解冠状动脉痉挛
B. 给予补液，以补充循环血容量
C. 给予洋地黄制剂，以增加心肌收缩力
D. 给予β受体阻滞剂，以降低心室率
E. 给予血管扩张剂，以降低心脏前后负荷

正确答案：E。给予血管扩张剂，以降低心脏前后负荷

解析：急性广泛前壁心肌梗死患者，胸闷憋气明显，心率140次/分，双肺可闻及弥漫性小水泡音，诊断为急性心肌梗死伴左心功能不全，正确的处理应尽快控制心衰，首选给予血管扩张剂，以减少心脏前后负荷（E对）。钙拮抗剂对本例可作为辅助治疗药物（A错）。补液需慎重以免增加心脏负荷而加重心衰（B错）。由于是急性心肌梗死，所以洋地黄应慎用（C错）。β受体阻滞剂在急性心梗起病早期可应用，以防止梗死范围扩大，但当伴有严重心功能不全时应慎用或不用（D错）。